急性阑尾炎病人，当腹痛尚未转移至右下腹时，在诊断有重要意义的是
A. 己出现发热
B. 有白细胞显著升高
C. 已有脐周压痛反跳痛
D. 脐区及右下腹具有压痛反跳痛
E. 压痛己固定在右下腹

正确答案：E。压痛己固定在右下腹

解析：阑尾一般位于右下腹，急性阑尾炎时，右下腹固定压痛（E对）可提示阑尾炎症的存在和其所在的部位，在腹痛尚未转移至右下腹之前即可出现，较转移性腹痛更具有诊断意义。发热（A错）、白细胞升高（B错）仅可提示感染，但阑尾炎的诊断无特异性。急性阑尾炎早期，炎症多局限于右下腹，因此腹部压痛、反跳痛等多局限于右下腹，晚期阑尾穿孔、坏疽后，炎症蔓延至全腹腔，压痛、反跳痛和腹肌紧张等亦可遍及全腹（CD错）。急性阑尾炎时脐周痛为牵涉痛，不是由于阑尾炎的炎性渗液刺激壁腹膜所致。